明代最有成就的中医外科学著作是
A. 《外科正宗》
B. 《疡科心得集》
C. 《外科大成》
D. 《外科全生集》
E. 《霉疮秘录》

正确答案：A。《外科正宗》

解析：明代陈实功的《外科正宗》体现了明以前外科学的主要成就，被后世医家评价为列证最详，论治最精（A对）。《疡科心得集》， 是清代高锦庭的著作（B错）。《外科大成》是清代祁坤的著作（C错）。《外科全生集》，是清代王维德的著作（D错）。此三者皆为清代著作。《霉疮秘录》，是明代陈司成的著作，是我国第一部梅毒病专著，书中指出梅毒由性交传染且可遗传，并详细记录了应用砷、汞剂治疗梅毒的方法（E错）。